驾驶员患过敏疾病时可选用的药物是
A. 氯雷他定
B. 苯海拉明
C. 异丙嗪
D. 氯苯那敏
E. 赛庚啶

正确答案：A。氯雷他定

解析：本题考查驾驶员用药。驾驶员患过敏疾病时可选用的药物是氯雷他定（A对）。过敏时尽量选用对中枢神经抑制作用小的抗过敏药如咪唑斯汀、氯雷他定、地氯雷他定。苯海拉明（B错）、异丙嗪（C错）、氯苯那敏（D错）、赛庚啶（E错）服用后可致嗜睡，驾驶员应慎用。